28岁初产妇，妊娠39周，枕右前位。阵发性腹痛9小时，宫缩9分钟一次，持续35秒，宫口开大2cm。若已进入第二产程，S＝+3，胎心140次/分，此时处理应是
A. 等待自然分娩
B. 继续加强宫缩等待分娩
C. 胎头吸引器助产
D. 产钳助产
E. 立即行剖宫产术

正确答案：B。继续加强宫缩等待分娩

解析：青年初产妇，宫口开大2cm，经历9小时（＜16小时），说明处于潜伏期（潜伏期指从宫口开始扩张至扩张3cm，需8小时，最大时限16小时），宫缩9分钟一次（＞5～6分钟），持续35秒（＞30秒），故最可能的原因是子宫收缩节律异常。该产妇胎头已达坐骨棘平面以下3cm（S＋3），胎心正常，由于宫缩乏力，故需继续加强宫缩等待分娩（B对A错）。若无效可行会阴后-侧切开以产钳助产术（D错）或胎头吸引术（C错）结束分娩。若出现胎儿窘迫，应立即行剖宫产，但是本例，无胎儿窘迫，故不需要立即行剖宫产术（E错）。